急性肾衰竭选择血液净化疗法时，血钾（mmol/L）至少应达到
A. 5
B. 5.5
C. 6
D. 6.5
E. 7

正确答案：D。6.5

解析：把血液引出体外通过血液净化装置，除去其中的某些致病物质，达到净化血液的目的，这个过程即为血液净化，包括血液透析、血液灌流、血浆置换。血钾＞5.5mmol/L称为高钾血症，＞6.5mmol/L（D对）则为严重高钾血症。应及处理，否则有心搏骤停危险。